治疗妊娠期高血压，首选的解痉药是
A. 安定
B. 654-2
C. 硫酸镁
D. 阿托品
E. 冬眠合剂

正确答案：C。硫酸镁

解析：由于硫酸镁（C对）可作用于周围血管神经肌肉交接处，减少乙酰胆碱释放，使骨骼肌松弛；刺激前列环素产生，抑制内皮素合成，降低机体对血管紧张素II的反应，阻断钙离子内流，缓解血管痉挛；提高孕妇和胎儿血红蛋白的亲和力，改善氧代谢。安定（A错）具有镇静作用，能解除患者的焦虑和紧张，达到降压、缓解症状、预防子痫发作的作用，没有解痉作用。654-2（B错）是为阻断M胆碱受体的抗胆碱药，作用与阿托品相似或稍弱。主要用于解除平滑肌 痉挛，胃肠绞痛、胆道痉挛以及急性微循环障碍及有机磷中毒等，不是妊娠期女性解痉的首选。阿托品（D错）同654-2作用机理相似，同样非妊娠高血压解痉首选药物。冬眠合剂（E错）具有解痉降压、控制子痫的作用，现仅用于硫酸镁治疗效果不佳者，非首选药物。